含有喹啉酮环母核结构的药物是
A. 氨苄西林
B. 环丙沙星
C. 尼群地平
D. 格列本脲
E. 阿昔洛韦

正确答案：B。环丙沙星

解析：本题考查环丙沙星。环丙沙星（B对）为喹诺酮类抗菌药物，具有1，4-二氢-4-氧代喹啉（或氮杂喹啉）-3-羧酸结构。氨苄西林（A错）属于青霉素类β-内酰胺抗菌药；尼群地平（C错）为1，4-二氢吡啶类钙通道阻滞剂；格列本脲（D错）为磺酰脲类胰岛素分泌促进剂，具有磺酰脲结构；阿昔洛韦（E错）是人工合成的鸟嘌呤核苷类似物。以上四种药物均不含有喹啉酮结构。